卡环固位臂尖应位于基牙的
A. 外形高点线上
B. 外形高点线（牙合）方
C. 外形高点线龈方
D. 导线的（牙合）方
E. 导线的龈方

正确答案：E。导线的龈方

解析：本题考查观测线与卡环。卡环固位臂尖应位于基牙的导线的龈方（E对）。导线，又称观测线，是将模型固定在观测台上，选好就位道后，沿牙冠轴面最突点所描画出的用以区分软硬组织倒凹区与非倒凹区的分界线。与基牙外形高点线相区别，当基牙牙冠有不同程度的倾斜时，导线的位置也随之改变，这样所得的导线并不是基牙的解剖外形高点线（ABC错），而是随观测方向改变而改变的连线。导线的（牙合）方（D错）为基牙的非倒凹区，导线的龈方为基牙的倒凹区。卡环固位臂卡应位于基牙的倒凹区内，以起到主要的固位作用。